某药厂生产的清开灵注射液，其药物组成包括胆酸、珍珠母（粉）、猪去氧胆酸、栀子、水牛角（粉）、板蓝根、黄芩苷、金银花；附加剂为依地酸二钠、硫代硫酸钠、甘油。具有清热解毒、化瘀通络、醒神开窍。根据中药注射剂生产要求，处方中原料药应固定产地，板蓝根的生产地是
A. 广东
B. 山西
C. 河北
D. 四川
E. 黑龙江

正确答案：C。河北

解析：本题考查的是板蓝根的产地。板蓝根的生产地是河北（C对）。板蓝根：【产地】主产于河北、江苏、河南、安徽。此外，全国许多地区均有栽培。主产于广东（A错）的药材有粉葛、巴戟天、土茯苓、鸡血藤、沉香、金樱子、砂仁、广藿香、海金沙、海马、金钱白花蛇等。主产于山西省（B错）的药材有苦参、黄芪、远志、党参、香加皮、连翘、蒲公英、硫黄等。 主产四川（D错）的药材为川药。川药：主产地四川、西藏等。如川贝母、川芎、黄连、川乌、附子、麦冬、丹参、干姜、白芷、天麻、川牛膝、川楝子、川楝皮、川续断、花椒、黄柏、厚朴、金钱草、五倍子、冬虫夏草、麝香等。主产于黑龙江省（E错）的药材有绵马贯众、升麻、人参、龙胆、五味子、鹿茸等。